属于肿瘤相关抗原的分子是
A. TNF
B. LPS
C. IFN
D. CEA
E. HBsAg

正确答案：D。CEA

解析：肿瘤相关抗原是指肿瘤细胞和正常细胞组织均可表达的抗原，只是其含量在细胞癌变时明显增高。癌胚抗原、组织特异性分化抗原和过量表达的抗原均属于此类。CEA（D对）属于癌胚抗原，属于肿瘤相关抗原。TNF（A错）为肿瘤坏死因子，是能使肿瘤发生出血、坏死的细胞因子。LPS（B错）革兰氏阴性细菌细胞壁最外层的一层较厚（8-10nm）的类脂多糖类物质，由类脂A、核心多糖和O-特异侧链3部分组成，为旁路激活途径的激活物。IFN（C错）为干扰素，可干扰病毒的感染和复制。HBsAg（E错）是乙肝病毒的外壳蛋白，本身不具有传染性，但它的出现常伴随乙肝病毒的存在，所以它是已感染乙肝病毒的标志。